不属于臂丛的神经为
A. 尺神经
B. 桡神经
C. 膈神经
D. 肌皮神经
E. 腋神经

正确答案：C。膈神经

解析：尺神经（A对）、桡神经（B对）、肌皮神经（D对）、腋神经（E对）均为臂丛的分支。膈神经（C错，为本题正确选项）属于颈丛的分支。